关于抽样调查，以下哪个是正确的
A. 目的是为了早期发现、早期诊断、早期治疗宫颈癌
B. 为了调查大学生乙型肝炎感染情况，可不必调查所有大学的全部学生
C. 一项在健康人中发现可疑的肺结核患者的调查
D. 对个别发生的麻疹患者进行调查
E. 一次因会餐引起的食物中毒调查

正确答案：B。为了调查大学生乙型肝炎感染情况，可不必调查所有大学的全部学生